太阳经头痛的部位在
A. 巅顶部
B. 前额部
C. 后枕部
D. 颞部
E. 顶颞部

正确答案：C。后枕部

解析：太阳经头痛在后头部（C对）；厥阴头痛在巅顶部（A错）；前额痛（B错）为阳明头痛；偏头痛为少阳头痛，在两侧颞部（D错）。